不属于化学性元素性地方病的疾病是
A. 克汀病
B. 克山病
C. 氟斑牙
D. 水俣病

正确答案：D。水俣病

解析：本题考查生物地球化学性疾病。生物地球化学性疾病是指由于地壳表面化学元素分布的不均匀性，使某些地区的水和（或）土壤中某些元素过多或过少，当地居民通过饮水、食物等途径摄入这些元素过多或过少，而引起某些特异性疾病。克汀病（A对）、克山病（B对）、氟斑牙（C对）均属于生物地球化学性疾病，水俣病（D错，为本题正确答案）是因食入被有机汞污染河水中的鱼、贝类所引起的甲基汞为主的有机汞中毒，不属于生物地球化学性疾病。